在现场调查时，当问及某个敏感问题时，很多被调查对象倾向于夸大或掩盖真实情况，此时可能引起的偏倚是
A. 暴露怀疑偏倚
B. 报告偏倚
C. 无应答的偏倚
D. 诊断怀疑偏倚
E. 测量偏倚

正确答案：B。报告偏倚